在阴阳失调的病机变化中，“阴”的含义指“阴邪”的是
A. 阴虚则阳亢
B. 阳盛则阴病
C. 阴盛则阳病
D. 阴损及阳
E. 阳盛格阴

正确答案：C。阴盛则阳病

解析：阴盛则阳病指在疾病过程中所出现的阴邪偏盛、功能抑制、机体反应性减弱而产生寒象的病机变化，当阴邪偏盛伤及阳气时，可兼有脘腹冷痛，溲清，便溏等表现（C对）；阴虚则阳亢指机体阴液不足，阴不制阳，阳气相对偏盛（A错）；阳盛则阴病指在疾病过程中出现阳邪偏盛，伤及阴液，导致口渴、小便短少等症（B错）；阴损及阳指由于阴气亏损，累及阳气生化不足，或阳气无所依附而耗散从而在阴虚的基础上又出现阳虚，形成以阴虚为主的阴阳两虚的病机变化（D错）；阳盛格阴指阳气偏盛至极，壅遏于内，排斥阴气于外，而出现内真热外假寒的病机变化（E错）。